下列有关栓剂制备的叙述，错误的是
A. 不溶性药物一般应粉碎成细粉，过六号筛，再与基质混匀
B. 中药水提浓缩液可制成干浸膏粉与熔化的油脂性基质混匀，或用适量羊毛脂混合后再与油脂性基质混匀
C. 制备甘油明胶基质的药物栓剂时，模孔应涂用油性润滑剂
D. 制备可可豆脂基质的药物栓剂时，模孔应涂用水性润滑剂
E. 热熔法仅适用于油脂性基质栓剂而不适用于水溶性基质栓剂的制备

正确答案：E。热熔法仅适用于油脂性基质栓剂而不适用于水溶性基质栓剂的制备